能与碘化铋钾试剂反应生成沉淀的化合物是
A. 7-羟基黄酮
B. 七叶内酯
C. 大黄酸
D. 苦参碱
E. 葡萄糖醛酸

正确答案：D。苦参碱

解析：本题考查中药化学成分的络合反应。能与碘化铋钾试剂反应生成沉淀的化合物是苦参碱（D对）。碘化铋钾试剂为生物碱类沉淀试剂，反应特征为黄色至橘红色无定形沉淀。苦参碱为吡啶类生物碱。根据苷元的结构可分为氰苷、香豆素苷、木脂素苷、蒽醌苷、黄酮苷、吲哚苷等。如苦杏仁苷、七叶内酯苷（B错）、靛苷。苷元的结构多种多样。糖的显色反应中最重要的是Molish反应。Bornträger's反应：在碱性溶液中，羟基醌类颜色改变并加深，多呈橙、红、紫红及蓝色。如羟基蒽醌类化合物遇碱显红至紫红色，称为Bornträger's反应。大黄酸蒽酮（C错）为二蒽酮类化合物。黄芩经过蒸制或沸水煮既可杀酶保苷，防止将黄芩中的黄芩苷和汉黄芩苷酶分解成葡萄糖醛酸（E错）和黄芩素与汉黄芩素。